下列违背道德要求的是
A. 个人利益优先，兼顾社会利益
B. 社会利益优先，兼顾个人利益
C. 为人民服务
D. 尊老爱幼
E. 舍己为人

正确答案：A。个人利益优先，兼顾社会利益

解析：我国对公民的道德要求是：坚持以为人民服务（C对）为核心；以集体主义为原则，坚持社会利益优先，兼顾个人利益（A错，为本题正确答案）（B对），舍己为人（E对）；以“五爱”即爱祖国、爱人民、爱劳动、爱科学、爱社会主义为基本要求，尊老爱幼（D对），全面践行职业道德、社会公德、家庭美德、个人道德和环境道德。